男性，突发寒战，体温39℃左右，腹泻10余次，伴里急后重，便为稀便，很快转化为脓血便。便常规红细胞5/HP，白细胞10/HP，脓细胞（++）。该患者最可能的诊断是
A. 细菌性痢疾
B. 伤寒
C. 阿米巴痢疾
D. 肠炎
E. 食物中毒

正确答案：A。细菌性痢疾

解析：男性患者，突发寒战，体温39℃左右，腹泻10余次（细菌性痢疾急性期的常见表现），伴里急后重（提示病变累及直肠），粪便由稀便很快转为脓血便（菌痢能导致肠黏膜坏死、溃疡），便常规见红细胞、白细胞及脓细胞（符合菌痢的粪便检查结果），综合该患者的病史、体查、实验室检查，该患者最可能的诊断是细菌性痢疾（A对）。细菌性痢疾的表现特点有：①起病急，有寒战、发热，体温可达39℃；②腹泻次数常达10次/天以上，里急后重明显，一般呕吐较少；③肠黏膜溃疡、坏死严重，粪便多为黏液脓血便；④病变主要累及大肠，以乙状结肠和直肠为重，左下腹有明显压痛。伤寒（P150）（B错）在发病前可有寒战、高热表现，但通常起病缓慢，热度呈阶梯状上升，消化系统症状以便秘多见，仅10%左右患者出现腹泻（多为水样便），常伴缓脉、玫瑰疹、脾大等表现。阿米巴痢疾（P273）（C错）通常起病缓慢，全身症状轻，患者通常无发热或仅有低热，多为右下腹压痛，每天排便3～10次，粪便性状为粘液血便，粪质较多，通常呈暗红色果酱样，腥臭味浓，可检到滋养体及包囊。肠炎（D错）以胃肠道症状为主，多伴有恶心、呕吐、腹痛、消化不良等症状，腹泻类型多样，轻重不一。食物中毒（P159）（E错）起病急，常在进食后数小时发病，多伴有恶心、呕吐、腹痛等急性胃肠炎症状，常先吐后泻，呕吐物多为进食的食物。